患者因左下后牙龋坏就诊，一次银汞充填完成治疗，治疗后咬物疼痛。检查：左下6远中邻（牙合）面充填体完好，边缘密合，表面有亮点，叩（-），牙龈（-），温度测无异常。该牙应如何处理
A. 磨除高点，调（牙合）观察
B. 去除原充填体，重新充填
C. 去除原充填体，氧化锌丁香油糊剂安抚
D. 脱敏治疗
E. 开髓治疗

正确答案：A。磨除高点，调（牙合）观察

解析：本题考查充填后疼痛。患者因左下后牙龋坏就诊，一次银汞充填完成治疗，治疗后咬物疼痛。检查：左下6远中邻（牙合）面充填体完好，边缘密合，表面有亮点，叩（-），牙龈（-），温度测无异常。该牙应磨除高点，调（牙合）观察（A对）。检查可见患者左下6远中邻（牙合）面充填体表面有亮点，可知充填体存在咬合高点，导致咬物痛，该患牙的处理为磨除高点，调（牙合）观察。患者左下6远中邻（牙合）面充填体完好，边缘密合，牙龈正常，无食物嵌塞及龈缘悬突，无需去除原充填体，重新充填（B错）。患牙温度测验无异常，说明牙髓正常，不需安抚治疗及开髓治疗（CE错）。患牙温度测验正常，无冷热刺激敏感，无需脱敏治疗（D错）。